何者不是紧邻男性膀胱的结构
A. 精囊
B. 输精管
C. 输尿管
D. 前列腺
E. 尿道球腺

正确答案：E。尿道球腺

解析：尿道球腺（E错，为本题正确答案）位于会阴深横肌内，会阴深横肌（P168）为尿生殖区的深层肌，位于肛门附近。紧邻男性膀胱的结构有精囊（A对），输精管（B对），输尿管（C对），前列腺（D对）等